确诊流行性出血热的依据是
A. 鼠类接触史
B. 全身感染和中毒症状
C. "三痛"和"三红"征
D. 特异性IgM抗体滴度升高
E. 异型淋巴细胞增多

正确答案：D。特异性IgM抗体滴度升高

解析：特异性IgM抗体滴度升高（D对）可以确诊流行性出血热且有早期诊断价值，IgM抗体在病后1～3天即可检出（1：20为阳性），至发热后期其阳性率最高，持续3个月至半年逐渐消失；鼠类接触史（A错）只是流行病学的一个条件，并不能确诊；全身感染和中毒症状（B错）包括出现头痛、腰痛、眼眶痛“三痛”征，出现面红、颈红、上胸红“三红”征（C错），作为临床表现和伴随症状可作为诊断依据但不能确诊；异型淋巴细胞增多（E错）可见于多种疾病如传单，因此并不能确诊。